鉴定破伤风杆菌有无致病性最可靠依据是
A. G+杆菌
B. 菌体顶端有圆形芽胞
C. 产生破伤风痉挛毒素
D. 专性厌氧
E. 有周鞭毛

正确答案：C。产生破伤风痉挛毒素

解析：破伤风痉挛毒素是引起破伤风的主要致病物质。掌握“厌氧芽胞梭菌”知识点。